以上选项中，属于阿是穴特性的是
A. 以痛为输
B. 是经验效穴
C. 主治病证较多
D. 归属于十四经脉
E. 是腧穴的主要组成部分

正确答案：A。以痛为输

解析：阿是穴，穴位分类名，又名不定穴、天应穴、压痛点。这类穴位一般都随病而定，多位于病变的附近，也可在与其距离较远的部位，没有固定的位置和名称。它的取穴方法就是以痛为腧，即人们常说的“有痛便是穴”（A对）。临床上医生根据按压式病人有酸、麻、胀、痛、重等感觉和皮肤变化而予以临时认定。唐代孙思邈的《备急千金要方》载：“阿是之法，言人有病痛，即令捏其上，若里当其处，不问孔穴，即得便快成（或）痛处，即云阿是，灸刺皆验，故曰阿是穴”。